深睡眠时可能出现的体征是
A. Brudzinski征
B. Babinski征
C. Romberg征
D. Kernig征
E. Weber综合征

正确答案：B。Babinski征

解析：Babinski征的检查方法是：用竹签轻划足底外侧，自足跟向前至小趾根部足掌时转向内侧，反射为足趾趾屈（P118）。Babinski征（B对）是经典的病理反射，提示锥体束受损，也可见于婴儿和成年人深睡眠时。Brudzinski征（A错）和Kernig征（D错）均为脑膜刺激征，提示腰骶节段的脊神经根受刺激，可见于脑膜炎、蛛网膜下腔出血、脑水肿等（P119）。Romberg征（C错）及闭目难立征，见于小脑蚓部损害（P19）。Weber综合征（E错）及大脑脚综合征，见于中脑大脑脚脚底损害（P16）。